下列关于巨幼细胞性贫血的说法，错误的是
A. 老年人和酗酒者为高危人群
B. 恶性贫血者需要终生维持治疗
C. 可静脉滴注维生素B₁₂100~500㎍qd
D. 全胃切除的巨幼细胞性贫血患者需要终生维持治疗
E. 在不能确定只是单纯叶酸缺乏引起的贫血时，叶酸应联合维生素B₁₂治疗

正确答案：C。可静脉滴注维生素B₁₂100~500㎍qd

解析：本题考查巨幼红细胞性贫血。伴有神经系统表现者，应连续肌注维生素B₁₂ 250～500㎍，有时需要大剂量1000㎍，每周1次（C错，为本题正确答案）。巨幼细胞性贫血，6个月～2岁以内婴幼儿、老年人和酗酒者为高危人群（A对）。恶性贫血者（B对）和全胃切除者（D对）需要终生维持治疗。在不确定是叶酸缺乏还是维生素B₁₂ 缺乏或两者同时缺乏者，应同时联合叶酸和维生素B₁₂（E对）进行治疗。